标定硫代硫酸钠滴定液（0.1mol/1）的基准物是
A. 硫酸
B. 氯化钠
C. 邻苯二甲酸氢钾
D. 重铬酸钾
E. 无水碳酸钠

正确答案：D。重铬酸钾

解析：本题考查基准物的选择。标定硫代硫酸钠滴定液（0.1mol/1）的基准物是重铬酸钾（D对）。